某女，49岁。精神抑郁，情绪不宁，胸胁胀痛，胸闷嗳气善太息。舌苔薄腻，脉弦。医生诊断为郁证，其中医证候是
A. 气滞血瘀
B. 肝阳上亢
C. 心脾两虚
D. 痰气郁结
E. 肝气郁结

正确答案：E。肝气郁结

解析：本题考查的是郁证的辨证论治。精神抑郁，情绪不宁，胸胁胀痛，胸闷嗳气善太息。舌苔薄腻，脉弦。医生诊断为郁证，其中医证候是肝气郁结（E对）。郁证是由于情志不舒，气机郁滞所致，以心情抑郁，情绪不宁，胸部满闷，胁肋胀痛，或易怒喜哭，或咽中如有异物梗塞等症为主要临床表现的疾病。西医学的神经衰弱、癔症、抑郁症、焦虑症或抑郁状态以及围绝经期综合征等有上述表现者，可参考此内容辨证论治。（一）肝气郁结证：【症状】精神抑郁，情绪不宁，胸部满闷，胁肋胀痛，痛无定处，胸闷嗳气，喜太息，不思饮食，大便不调，或秘或溏泄。舌苔薄或腻，脉弦。（二）痰气郁结（D错）证：【症状】精神抑郁，胸部闷塞，胁肋胀满，咽中如有物梗塞，咽之不下，咯之不出。舌苔白腻，脉弦滑。（三）心神失养证：【症状】精神恍惚，心神不宁，多疑易惊，悲忧善哭，喜怒无常，或时时欠伸，或手舞足蹈，骂詈喊叫等。舌质淡，脉弦。（四）心脾两虚（C错）证：【症状】情绪不宁，多思善疑，头晕神疲，心悸胆怯，失眠健忘，食少纳呆，面色不华。舌质淡，苔薄白，脉细。气滞血瘀（A错）为胸痹的辨证。胸痹气滞血瘀证：【症状】心胸疼痛，如刺如绞，痛有定处，入夜为甚，重者心痛彻背，背痛彻心，或痛引肩背，伴有胸闷，日久不愈，可因暴怒、劳累而加重。舌质紫暗，有瘀斑，苔薄，脉弦细。肝阳上亢（B错）为眩晕的辨证。眩晕肝阳上亢证：【症状】眩晕，耳鸣，头目胀痛，口苦，失眠多梦，遇烦劳郁怒而加重，颜面潮红，急躁易怒。舌红苔黄，脉弦或数。